镇咳祛痰药
A. 盐酸丁丙诺啡
B. 盐酸纳洛酮
C. 二者均是
D. 二者均不是

正确答案：D。二者均不是